健康成人24小时尿中排出蛋白总量为
A. 0mg～150mg
B. 151mg～200mg
C. 201mg～250mg
D. 251mg～300mg
E. 301mg～350mg

正确答案：A。0mg～150mg

解析：健康成人24小时尿中排出蛋白总量为0mg～150mg（A对）。超过150mg/24h，称为蛋白尿（BCDE错）。